我国生活饮用水卫生标准中分别对铁和挥发酚、氟化物、游离性余氯都作出了明确的限量要求，这些指标为
A. 感官性状和一般化学指标、毒理学指标、细菌学指标
B. 特殊化学指标、毒理学指标、细菌学指标
C. 一般化学指标、特殊化学指标、毒理学指标
D. 感官性状指标、特殊化学指标、细菌学指标
E. 感官性状和一般化学指标、微量元素指标、细菌学指标

正确答案：A。感官性状和一般化学指标、毒理学指标、细菌学指标

解析：本题考查生活饮用水卫生标准指标。本题中铁和挥发酚为感官性状及一般化学指标；氟化物为毒理学指标；游离性余氯为细菌学指标（A对BCDE错）。